其性属阳的药是
A. 黄芩
B. 黄柏
C. 附子
D. 麦冬
E. 石斛

正确答案：C。附子

解析：本题考查的是药性。其性属阳的药是附子（C对）。药性，即寒、热、温、凉，又称“四气”。其中寒凉属阴（凉次于寒），温热属阳（温次于热）。具有减轻或消除热证作用的中药，一般具有寒性或凉性，如黄芩（A错）、栀子等。反之，具有减轻或消除寒证作用的中药，一般具有温性或热性，如附子、干姜之类。黄柏（B错）性苦、寒，属阴。麦冬（D错）性甘、微苦、微寒，属阴。石斛（E错）性苦、甘，寒，属阴。